花椒除了温中止痛外，又能
A. 杀虫止痒
B. 温经止血
C. 温中降逆
D. 杀虫消积
E. 温肺化饮

正确答案：A。杀虫止痒

解析：本题考查的是花椒的功效。花椒除了温中止痛外，又能杀虫止痒（A对）。花椒：【功效】温中止痛，杀虫止痒。艾叶：【功效】温经止血（B错），散寒止痛。丁香：【功效】温中降逆（C错），温肾助阳。使君子：【功效】杀虫消积（D错）。干姜：【功效】温中，回阳，温肺化饮（E错）。